参苓白术散的主治病证是
A. 脾虚湿盛证
B. 脾胃气虚证
C. 脾虚气陷证
D. 心脾两虚证
E. 脾肾两虚证

正确答案：A。脾虚湿盛证

解析：参苓白术散中人参、白术、茯苓益气健脾渗湿为君。配伍山药、莲子肉助君药以健脾益气，兼能止泻；白扁豆、薏苡仁助白术、茯苓以健脾渗湿，共为臣药。佐以砂仁醒脾和胃，行气化滞。桔梗宣肺利气，通调水道，又能载药上行，培土生金；炒甘草健脾和中，调和诸药，共为佐使。故诸药共奏健脾祛湿之效，主治脾虚湿盛证（A对）。四君子汤主治脾胃气虚证（B错）。补中益气汤主治脾虚气陷证（C错）。归脾汤主治心脾两虚证（D错）。脾肾阳虚之泄泻首选四神丸；脾肾气虚、冲脉不固证首选固冲汤（E错）。